一项样本量足够大并且实施严格的病例对照研究结果为：喜甜食与糖尿病的关系OR=1.2，95%CI为0.7～1.6，这意味着
A. 喜甜食与糖尿病有关
B. 该OR值有95%的可能是错误的
C. 喜甜食有95%可能性会增加患糖尿病的危险
D. 该结果存在偏倚的可能性为95%
E. 该OR值真实值在0.7～1.6之间的机会为95%

正确答案：E。该OR值真实值在0.7～1.6之间的机会为95%